至虚有盛候，其病机属于
A. 真虚假实
B. 真实假虚
C. 虚中夹实
D. 实中夹虚
E. 上虚下实

正确答案：A。真虚假实

解析：本题考查的是邪正盛衰的病机。至虚有盛候，其病机属于真虚假实（A对）。在特殊情况下，病变可出现本质与表现不一致的虚实真假变化，这对于全面认识疾病的发展及转化具有重要意义。1.虚实变化：在疾病的发展变化过程中，正气和邪气这两种力量不是固定不变的，而是正邪双方在其斗争的过程中，在力量对比上发生着消长盛衰的变化。一般来说，正气增长而旺盛，则必然促使邪气消退，反之，邪气增长而亢盛，则必然会损耗正气。随着体内邪正的消长盛衰，形成了病证的虚实变化。（1）实：实，即邪气亢盛，是以邪气盛为矛盾主要方面的病机变化。（2）虚：虚，即正气不足，是以正气虚损为矛盾主要方面的病机变化。2.虚实错杂：（1）实中夹虚（D错）：实中夹虚，是指以邪实为主，兼见正气虚损的病机变化。（2）虚中夹实（C错）：虚中夹实，是指以正虚为主，兼夹邪实的病机变化。3.虚实转化：（1）由实转虚：由实转虚，是指因疾病失治或治疗不当，以致病邪久留，损伤人体正气，导致疾病由实转化为虚。（2）因虚致实：因虚致实，是指因正气不足，无力驱邪外出，或正虚而内生水湿、痰饮、瘀血等病变产物的凝结阻滞，导致疾病由虚转化致实。4.虚实真假：（1）真实假虚（B错）：又称“大实有羸状”，是指病机的本质为“实”，但表现出“虚”的临床假象的病机变化。（2）真虚假实：又称“至虚有盛候”，是指病机的本质为“虚”，但表现出“实”的临床假象的病机变化。一般是由于正气虚弱，脏腑经络气血不足，功能减退，气化无力所致。上虚下实（E错），2022年考试指南未明确说明。